治疗窦性心动过缓
A. 解磷定
B. 安坦
C. 新斯的明
D. 阿托品
E. 左旋多巴

正确答案：D。阿托品

解析：本题考查阿托品。阿托品（D对）可用于治疗窦性心动过缓；解磷定（A错）为胆碱酯酶复活剂，临床主要用于有机磷中毒的解救；安坦（B错）（苯海索）为中枢M受体阻断药，临床主要用于帕金森综合征患者；新斯的明（C错）为易逆性胆碱脂酶抑制剂，临床用于重症肌无力、手术后腹气胀及尿潴留、阵发性室上性心动过速、肌松药的解毒；左旋多巴（E错）为拟多巴胺类药，进入中枢神经系统后转变为多巴胺发挥抗帕金森病的作用。